长时间接触噪声，听阈提高15～30dB，经数小时才能恢复听力，属何种类型听力损伤
A. 听觉适应
B. 暴震性耳聋
C. 听觉疲劳
D. 噪声性耳聋
E. 噪声性听力损伤

正确答案：C。听觉疲劳

解析：本题考查听觉疲劳的症状。听觉疲劳（C对ABDE错）是指较长时间停留在强噪声环境中，引起听力明显下降，听阈提高超过15～30dB，离开噪声环境后，需要数小时甚至数十小时听力才能恢复。通常以脱离接触后到第二天上班前的间隔时间为限，如果在这段时间内听力不能恢复，继续接触噪声，听觉疲劳则逐渐加重，可能发展为永久性听阈位移。